治疗痴呆髓海不足证，应首选
A. 七福饮
B. 还少丹
C. 转呆丹
D. 知柏地黄丸
E. 河车大造丸

正确答案：A。七福饮

解析：痴呆髓海不足证是由于肾经亏虚所致，治宜补肾益髓，填精养神，方选七福饮（A对）。还少丹为痴呆脾肾两虚证的选方，功能益气健脾，补肾益精（B错）。转呆丹多用于治疗痴呆痰浊蒙窍伴有肝郁化火，灼伤肝血心液所致心烦躁动，言语颠倒，歌笑不休，甚至反喜污秽者（C错）。知柏地黄丸可用于痴呆伴肝肾阴虚，阴虚火旺之证，功能滋阴降火（D错）。河车大造丸可用于痴呆髓海不足证缓治，功能补肾益精，非首选方（E错）。